有腐蚀性的药品是
A. 松节油
B. 氯化钡
C. 氢氧化钠
D. 甘露醇
E. 乳酶生

正确答案：C。氢氧化钠

解析：本题考查具有腐蚀性的药物。具有腐蚀性的药物有硫酸、盐酸、硝酸等几大强酸，氢氧化钠（C对）、氢氧化钾、氢氧化镁等几大强碱，浓溴水等。松节油（A错）为易燃液体。氯化钡（B错）是极毒性药品。